女，31岁，G2P0。停经85天，阴道不规则流血，无咳嗽、咯血。妇科检查：阴道黏膜未见异常，宫颈光滑，宫口可见血液流出，宫底平脐，质软，未触及胎体，未闻及胎心，血hCG100000U/L，应首先考虑的诊断是
A. 侵蚀性葡萄胎
B. 葡萄胎
C. 绒癌
D. 死胎
E. 先兆流产

正确答案：B。葡萄胎

解析：中年女性患者，G2P0，停经85天，阴道不规则隐痛，无咳嗽、咯血。妇科检查：阴道黏膜未见异常，宫颈光滑，宫口可见血液流出（停经后阴道流血为葡萄胎最常见的症状），宫底平脐，质软，未触及胎体，未闻及胎心。血HCG100000U/L（＞80000U/L）。综合患者的症状、体征及辅助检查，初步诊断为葡萄胎（B对）。侵蚀性葡萄胎（A错）表现为病变侵及子宫肌层内或子宫外转移灶组织中，可见到绒毛或退化的绒毛阴影。绒癌（C错）与侵蚀性葡萄胎相比，表现为病变未见绒毛结构。死胎（D错）指妊娠20周后胎儿在子宫内死亡。先兆流产（E错）指妊娠28周前先出现少量阴道流血，常为暗红色或血性白带，无妊娠物排出，随后出现阵发性下腹痛或腰背痛。